主要降低总胆固醇和低密度脂蛋白胆固醇的调血脂药是
A. 瑞舒伐他汀
B. 利血平
C. 阿昔莫司
D. 依折麦布
E. 苯扎贝特

正确答案：A。瑞舒伐他汀

解析：本题考查调血脂药。主要降低总胆固醇和低密度脂蛋白胆固醇的调血脂药是瑞舒伐他汀（A对）。瑞舒伐他汀降低血总胆固醇、低密度脂蛋白胆固醇（LDL-C）作用显著，同时能降低TG。利血平（B错）属于交感神经末梢抑制剂，用于高血压及高血压危象。阿昔莫司（C错）和苯扎贝特（E错）为主要降三酰甘油的药物。依折麦布（D错）是胆固醇吸收抑制剂。